根充恰填时根管内充填物应距根尖端
A. 0.1～0.2mm
B. 0.3～0.4mm
C. 0.5～2.0mm
D. 1.1～1.5mm
E. 1.6～2.0mm

正确答案：C。0.5～2.0mm

解析：恰填的标准是根管内充填物恰好严密填满根尖狭窄部以上的空间，充填物距离根尖端0.5～2mm，根尖部根管内无任何X线透射影像。掌握“根管充填”知识点。